暑淫的证候表现是
A. 头昏沉，嗜睡，胸脘痞闷
B. 口渴饮水，口唇鼻咽干燥
C. 发热恶热，汗出，气短神疲
D. 突发皮肤瘙痒、丘疹
E. 肠鸣腹泻，脘腹拘急冷痛

正确答案：C。发热恶热，汗出，气短神疲

解析：患者感受暑热之邪，由于暑性炎热，蒸腾津液，故见发热恶热，心烦汗出；暑邪耗气伤津故气短神疲（C对）。头昏沉，嗜睡，胸脘痞闷是湿淫证的表现（A错）。口渴饮水，口唇鼻咽干燥是燥淫证的表现（B错）。突发皮肤瘙痒、丘疹是风淫证的表现（D错）。肠鸣腹泻，脘腹拘急冷痛是寒淫证的表现（E错）。